药品说明书关于复方制剂的说法正确的是
A. 复方制剂的药品名称一项中应写上“本品为复方制剂，其组分为：……
B. 复方制剂药理作用可为每一组成成份的药理作用
C. 复方制剂非临床毒理研究内容应为复方制剂毒性研究结果
D. 复方制剂配伍与药代动力学无关时，则不必在说明书中列出药代动力学项
E. 复方制剂说明书中一般不列规格这一项

正确答案：A、B、C、D、E。复方制剂的药品名称一项中应写上“本品为复方制剂，其组分为：……；复方制剂药理作用可为每一组成成份的药理作用；复方制剂非临床毒理研究内容应为复方制剂毒性研究结果；复方制剂配伍与药代动力学无关时，则不必在说明书中列出药代动力学项；复方制剂说明书中一般不列规格这一项